关于“基因表达”的叙述，错误的是
A. 所有基因表达都经历转录和翻译过程
B. 某些基因表达经历转录和翻译过程
C. 某些基因表达产物是蛋白质分子
D. 某些基因表达产物不是蛋白质分子
E. 某些基因表达产物是RNA分子

正确答案：A。所有基因表达都经历转录和翻译过程